心位于胸腔内与周围器官密切相关，是血液循环的核心器官。心内注射常选择的部位是
A. 右侧第3肋软骨上缘
B. 左侧第2肋软骨下缘
C. 左侧第5肋间，锁骨中线内侧1～2cm
D. 右侧第6胸肋关节处
E. 胸骨左缘第4肋间隙

正确答案：E。胸骨左缘第4肋间隙

解析：在胸骨左缘第4肋间隙（E对）与胸骨左侧缘处进行心内注射，一般不会伤及胸膜和肺。